某男，58岁。素患痰阻心窍之神志恍惚，近日又患咳嗽痰多。宜选用的中药是
A. 合欢皮
B. 酸枣仁
C. 夜交藤
D. 珍珠
E. 远志

正确答案：E。远志

解析：本题考查远志的主治病证。宜选用的中药是远志（E对）。远志【主治病证】（1）心神不安，惊悸，失眠，健忘。（2）痰阻心窍之癫痫发狂、神志恍惚。（3）咳嗽痰多。（4）痈疽肿痛，乳痈肿痛。合欢皮（A错）【主治病证】（1）忿怒忧郁，烦躁不眠。（2）跌打骨折，疮痈，肺痈。酸枣仁（B错）【主治病证】（1）阴血亏虚之心神不安、失眠多梦、惊悸怔忡。（2）自汗，盗汗。夜交藤（C错）【主治病证】（1）虚烦失眠多梦。（2）血虚身痛肢麻，风湿痹痛。珍珠（D错）【主治病证】（1）心悸，失眠，癫痫，惊风。（2）目赤肿痛，翳障胬肉。（3）喉痹，口疮，溃疡不敛。（4）皮肤色斑。